诸涩枯涸，干劲皴揭，皆属于
A. 风
B. 火
C. 燥
D. 心
E. 热

正确答案：C。燥

解析：《内经》曰：“诸痛痒疮，皆属于心。诸禁鼓栗，如丧神守，皆属于火…诸胀腹大，皆属于热”刘完素补充曰：“诸涩枯涸，干劲皴揭，皆属于燥（C对）”。“诸风（A错）掉眩，皆属于肝。诸禁鼓栗，如丧神守，皆属于火（B错）。诸痛痒疮，皆属于心（D错）。诸病有声，鼓之如鼓，皆属于热（E错）。”